休克监测中最常用的项目是
A. 心脏指数
B. 血气分析
C. 肺动脉楔压
D. 中心静脉压
E. 心排出量

正确答案：D。中心静脉压

解析：选项均为休克的特殊监测指标，其中中心静脉压（D对）为最常用的监测项目。中心静脉压代表了右心房或者胸腔段腔静脉内压力的变化，可反映全身血容量与右心功能之间的关系，且较动脉压变化要早、要敏感，故临床上常用。心排出量（E错）是心率和每搏排出量的乘积，心脏指数（A错）是单位体表面积上的心排出量，两者都是反映心功能的指标，其测定需放置心导管，风险较大。血气分析（B错）只能反映晚期休克的严重程度和复苏情况，不利于早期休克的监测。肺动脉楔压（C错）可反映肺静脉、左心房、右心室的功能状态，需放置肺动脉导管，可能产生严重并发症。